硝普钠最常见的不良反应是
A. 低血压
B. 高钾血症
C. 硫氰酸盐中毒
D. 室性心律失常
E. 血管神经性水肿

正确答案：A。低血压

解析：硝普钠能直接松弛血管平滑肌，强有力地扩张小动脉和静脉，所以最常见的不良反应是低血压（A对）。该药在体内迅速分解为氰化物，经肝脏代谢为基本无毒的硫氨酸盐，经肾脏排出，如剂量过大，或静脉滴注速度过快，不仅引起降压过甚，使脑血流量明显减少，诱发脑水肿，而且可导致氰化物在体内蓄积，引起氰化物中毒，但较低血压少见（C错）。高钾血症、室性心律失常、血管神经性水肿并不是硝普钠的常见反应（BDE错）。